在体内通过抑制黄嘌呤氧化酶，减少尿酸的生物合成，降低血中尿酸溶液的抗痛风药物是
A. 丙磺舒
B. 苯溴马隆
C. 别嘌醇
D. 秋水仙碱
E. 盐酸赛庚啶

正确答案：C。别嘌醇

解析：本题考查别嘌呤。别嘌醇（C对）可抑制黄嘌呤氧化酶，使次黄嘌呤及黄嘌呤不能转化为尿酸，即尿酸合成减少，进而降低血中尿酸浓度，减少尿酸盐在骨、关节及肾脏的沉着。丙磺舒（A错）抑制尿酸盐在近曲肾小管的主动再吸收，增加尿酸盐的排泄而降低血中尿酸盐的浓度。苯溴马隆（B错）通过抑制肾小管对尿酸的重吸收,从而降低血中尿酸的浓度。秋水仙碱（D错）可以抑制关节炎症部位的白细胞聚集，使白细胞吞噬尿酸的作用减弱，局部白细胞引起的炎症反应减轻。盐酸赛庚啶（E错）为抗过敏类药物。